60岁男性。活动中突感眩晕，头痛，呕吐，行走不稳，20分钟后昏迷，呼吸节律不整，诊断为脑出血，其部位为
A. 脑颞叶
B. 小脑
C. 脑桥
D. 基底节
E. 脑室

正确答案：B。小脑

解析：患者活动中头痛、呕吐，眩晕和共济失调明显，符合小脑（B对）出血的表现。患者病情进展迅速，出现昏迷及脑干受累症状，20分钟后即出现昏迷、呼吸中枢受累症状，考虑小脑出血的出血量较大导致脑干受压。脑颞叶（A错）出血可有Wernicke失语、精神症状、对侧上象限盲、癫痫（P190）。脑桥（C错）出血常破入第四脑室，患者迅即出现昏迷、双侧针尖样瞳孔、呕吐咖啡样胃内容物、中枢性高热、中枢性呼吸障碍、眼球浮动、四肢瘫痪和去大脑强直发作等症状（P190）。基底节（D错）出血常有病灶对侧偏瘫、偏身感觉缺失和同向性偏肓，还可出现双眼球向病灶对侧同向凝视不能（P189）。脑室出血（E错）症状类似于蛛网膜下腔出血，表现为头痛、呕吐（P190）。ACDE均无共济失调。